下列各项，不属清热药适应范围的是
A. 气分实热证
B. 阴盛格阳证
C. 血分实热证
D. 阴虚内热证
E. 湿热内蕴证

正确答案：B。阴盛格阳证

解析：本题考查清热药的分类及各类清热药的功效与主治。清热药是以清解里热、治疗里热证为主的药物。题中气分实热证、血分实热证、阴虚内热证和湿热内蕴证均为里热证，属于清热药的适应范围（ACDE错）。阴盛格阳是体内阴寒过盛，格拒阳气于外的真寒假热证，其本质是真寒证，不属于清热药适应范围（B对）。